口腔癌危险度为6.0的每天吸烟量是
A. 10～19支
B. 40～49支
C. 1～9支
D. 20～29支
E. 30～39支

正确答案：A。10～19支

解析：本题考查口腔癌。口腔癌危险度为6.0的每天吸烟量是10～19支（A对）。口腔癌的危险度与吸烟量、吸烟时间的长短成正相关。假设不吸烟的危险度是1，每天10～19支，危险因素上升为6.0（A对C错）；每天40～49支，危险因素上升为12.4（B错）；每天20支以上，危险因素上升为7.7（DE错）。